简便易行，但有时塑形较困难的是
A. 单纯游离骨移植术
B. 成形性松质骨移植术
C. 带肌蒂的骨移植术
D. 血管吻合游离骨移植术
E. 多元性游离骨移植术

正确答案：A。单纯游离骨移植术

解析：单纯游离骨移植术其优点是简便易行，但有时塑形较困难；植骨可发生部分或甚至完全吸收是其缺点。掌握“骨移植”知识点。